初产妇，24岁。妊娠38周，凌晨3时出现规律宫缩，19时30分宫口开大2厘米，此时的诊断是
A. 第二产程停滞
B. 第二产程延长
C. 活跃期停滞
D. 活跃期延长
E. 潜伏期延长

正确答案：E。潜伏期延长

解析：青年初产妇，妊娠38周，凌晨3时出现规律宫缩，19时30分宫口开大2cm（仍处于潜伏期），用时16.5小时（＞16小时），可诊断为潜伏期延长（E对）。初产妇第二产程＞2小时（硬膜外麻醉无痛分娩时以超过3小时为标准），经产妇第二产程＞1小时，称为第二产程延长（B错）。八版妇产科学并未提及第二产程停滞（A错）的概念，且该产妇未达第二产程。活跃期停滞（C错）是指活跃期宫口扩张停止＞4小时。活跃期延长（D错）是指活跃期超过8小时。九版妇产科学提出初产妇＞20小时、经产妇＞14小时称为潜伏期延长，本题原答案选E，但按最新版教材，本题无正确答案。